正常足月儿的出生体重是
A. ＜1000克
B. ＞1000克
C. ＞1500克
D. ＞2000克
E. ＞2500克

正确答案：E。＞2500克

解析：正常正常足月儿的出生体重应≥2500g（E对），并≤4000g。